评价某预防规划实施效果，在个足够长的观察期内，将预防规划实施前后该地区人群的疾病和健康状况进行了对比，这属于
A. 标准对照
B. 空白对照
C. 安慰剂对照
D. 自身对照
E. 历史对照

正确答案：D。自身对照

解析：本题考查实验流行病学对照的类型。对照的类型有标准对照、安慰剂对照、平行对照、交叉对照、自身对照、历史对照、空白对照等。其中自身对照（D对ABCE错）是指试验前后以同一人群作对比。如评价某预防规划实施效果，在试验前需要规定一个足够的观察期限，然后将预防规划实施前后人群的疾病和健康状况进行对比。